左侧小指皮肤的痛觉传导与下述哪个结构有关
A. 左侧正中神经
B. 左侧楔束
C. 右侧内侧丘系
D. 左侧脊髓丘脑束
E. 右侧脊髓丘系

正确答案：E。右侧脊髓丘系

解析：左侧小指皮肤的痛觉传导属于浅感觉传导通路，由三级神经元组成。第1级神经元为脊神经节内假单极神经元，第二级神经元发出纤维上升 1-2 个节段经白质前连合交叉到对侧的外侧索和前索内上行，组成脊髓丘脑侧束和脊髓丘脑前束（侧束传导痛温觉，前束传导粗略触觉和压觉），第3级神经元的胞体在背侧丘脑的腹后外侧核。因为第二级神经元经白质前连合交叉至对侧，所以左侧小指皮肤的痛觉传导至右侧脊髓丘系（E对）。